颌面外伤清创时下述哪项是错误的
A. 尽量保留软组织
B. 除确已坏死的组织外，一般仅将创缘略加修整即可
C. 唇、鼻、眼睑等重要部位的撕裂伤，组织大部分游离，即使没有感染也应去除
D. 应注意探查有无面神经损伤
E. 应注意探查有无骨折发生

正确答案：C。唇、鼻、眼睑等重要部位的撕裂伤，组织大部分游离，即使没有感染也应去除

解析：冲洗创口后，行创口周围皮肤消毒、铺巾、进行清创处理。原则上尽可能保留颌面部受伤组织。除确已坏死的组织外，一般仅将创缘略加修整即可。唇、舌、鼻、耳及眼睑等重要部位的撕裂伤，即使大部分游离或完全离体，只要没有感染和坏死的情况下，也应尽量保留，争取缝回原位，仍有可能成活。掌握“口腔颌面部软组织创伤”知识点。